某男，60岁，咳呛气急，痰少质黏，时时咯血，午后潮热，颧红，盗汗，口渴，烦躁易怒，胸痛，形体日渐消瘦，舌质红绛，苔薄黄，脉细数。治疗应选用
A. 月华丸
B. 百合固金丸
C. 保真汤
D. 补天大造丸
E. 桑菊饮

正确答案：B。百合固金丸

解析：患者咳呛气急，痰少质黏，时时咯血，故诊断为肺结核；肺阴亏虚，虚热内灼，肺失润降，故见咳呛气急；虚火灼津为痰，肺损络伤，故见痰少质黏，时时咯血；阴虚火旺，故见午后潮热，颧红，盗汗；津液不能润泽上承，故见口渴；虚火上炎则烦躁易怒，胸痛；虚火耗伤人体，阴津不能充养则见形体日渐消瘦；舌质红绛，苔薄黄，脉细数，均为肺结核阴虚火旺证的特点，治法为滋阴降火，方药选用百合固金汤合秦艽鳖甲散加减（B对）。月华丸（A错）可以滋阴润肺，用于治疗肺结核肺阴亏损证。保真汤（C错）可以益气养阴，用于治疗肺结核气阴耗伤证。补天大造丸（D错）可以滋阴补阳，用于治疗肺结核阴阳两虚证。桑菊饮（E错）可以疏风清热，宣肺止咳，用于治疗风温初起，但咳，身热不甚，口微渴者。